碘解磷定用于解救
A. 砷盐中毒
B. 有机磷中毒
C. 铅盐中毒
D. 一氧化碳中毒
E. 氰化物中毒

正确答案：B。有机磷中毒

解析：本题考查中毒解救。碘解磷定（解磷定）用于有机磷中毒（B对）。砷盐中毒（A错）解救一般选用二巯丙醇、二巯丁二钠等。铅盐中毒（C错）宜选用依地酸钙钠效果最好。一氧化碳中毒（D错）可用谷胱甘肽进行解毒。氰化物中毒（E错）选用亚甲蓝和硫代硫酸钠、亚硝酸钠等。